按照中药丸剂的特点通常含有刺激性中药的处方宜制成的丸剂是
A. 水丸
B. 糊丸
C. 浓缩丸
D. 蜜丸
E. 滴丸

正确答案：B。糊丸

解析：本题考查的是糊丸的特点。按照中药丸剂的特点通常含有刺激性中药的处方宜制成的丸剂是糊丸（B对）。糊丸的特点：①溶解迟缓，释药缓慢，“取其迟化”可延长药效。②减少药物对胃肠道的刺激性。含毒性或刺激性饮片以及需延缓药效的方药，可制成糊丸。水丸（A错）的特点：①丸粒较小，表面光滑，便于服用，不易吸潮，利于贮存。②可根据药物性质分层泛丸。将易挥发、刺激性等药物泛入内层，可掩盖药物的不良气味，提高挥发性成分的稳定性；或将缓释、速释药物分别泛入丸剂内、外层，制成长效制剂。③易溶散，吸收、显效较快，尤适于中药解表和消导制剂。④生产设备简单，可小量制备或大量生产。⑤多采用饮片细粉泛制，易引起微生物污染；药物的均匀性及溶散时限也较难控制。浓缩丸（C错）的特点：①浓缩丸中部分或全部饮片经提取浓缩（抑或纯化）处理，具有体积和服用剂量小，易于吸收，服用、携带及贮存方便等优点。②浓缩过程受热时间较长，因此应注意某些成分可能会受影响。蜜丸（D错）的特点：①性质柔润，作用缓和持久。②有补益和矫味作用，由于蜂蜜含有大量的糖、有机酸及维生素等丰富的营养成分，具有滋补作用；味甜能矫味；同时蜂蜜具有镇咳、缓下、润燥、解毒的作用。滴丸（E错）的特点：①生物利用度高，尤其是难溶性药物，在水溶性基质中高度分散可形成固体分散体，溶出速度快，奏效迅速，适用于急症治疗。②滴丸剂量准确，药物在基质中分散均匀，丸重差异小。③可选用不同基质制成不同释药速度的制剂（如缓释、控释制剂），可使液体药物固体化（如聚乙二醇基质可容纳5%～10%的液体等）。④生产设备简单，生产周期短，自动化程度高，生产成本较低。⑤滴丸载药量较小，而且目前可供选用的理想基质和冷凝剂较少，使其发展受限。